蝉蜕具有的功效是
A. 透疹，利咽消肿
B. 透疹，利咽，清利头目
C. 透疹，明目退翳
D. 透疹，解肌清热
E. 透疹，清热解毒

正确答案：C。透疹，明目退翳

解析：蝉蜕甘寒质轻，疏散清透解痉，功在肺、肝二经。长于祛风解痉与明目开音，主治风热、肝热或肝风所致诸疾。功效疏散风热，利咽开音，透疹，明目退翳，解痉（C对）。透疹，利咽消肿（A错）是牛蒡子的功效。透疹，利咽，清利头目（B错）是薄荷的功效。透疹，解肌清热（D错）是葛根的功效。透疹，清热解毒（E错）是升麻的功效。